在某地进行男性吸烟与膀胱癌关系的大量研究，资料如下：吸烟组膀胱癌发病率为48.0/10万，不吸烟组膀胱癌的发病率为25.4/10万。根据该资料，比较男性吸烟和不吸烟与膀胱癌关系的相对危险度为
A. 48
B. 48.0－25.4＝22.6
C. 48.0/25.4＝1.89
D. （48.0－25.4）/48.0
E. 本资料不能计算

正确答案：C。48.0/25.4＝1.89

解析：本题考查相对危险度的计算。相对危险度比是暴露组的危险度（测量指标是累积发病率）与对照组的危险度之比。计算为相对危险度＝48.0/25.4＝1.89（C对ABDE错）。